治疗高血压伴心率过快，应首选的药物是
A. α受体阻断药
B. β受体阻断药
C. 钙通道拮抗剂
D. 利尿剂
E. 血管紧张素转化酶抑制药

正确答案：B。β受体阻断药

解析：β受体阻断药可以通过阻断心脏β₁受体，使心肌收缩力减弱，减慢心率（治疗心率过快），传导减慢，心排出量减少，心肌耗氧量降低。还可以通过阻断血管平滑肌上的β₂受体，加之心脏功能被抑制，反射性地兴奋交感神经，引起血管收缩，外周阻力增加，使血管的血流量减少（治疗高血压）。β受体阻断药适用于1、2级高血压患者，尤其是心律较快的中青年患者，或合并心绞痛、心肌梗死、慢性心力衰竭、交感神经活性增高及高动力状态的高血压患者（B对）。α受体阻断药一般不作为高血压的首选药。适用于高血压伴前列腺增生等患者，也用于难治性高血压患者的治疗（A错）。钙通道拮抗剂可用于中、重度高血压的治疗，适宜于单纯性收缩压增高的老年病患者（C错）。利尿剂用于轻、中度高血压，适用于老年高血压、单纯收缩期高血压、难治性高血压、心力衰竭合并高血压的治疗（D错）。血管紧张素转化酶抑制药对伴有心力衰竭、左心室肥大、心肌梗死后、房颤、蛋白尿或微量白蛋白尿、慢性肾脏疾病、代谢综合征、糖耐量降低及糖尿病肾病等合并症尤为适宜（E错）。